土壤对重金属的环境容量是指
A. 重金属溶解在土壤中的最大值
B. 土壤中重金属不对农作物产生危害的最高限值
C. 土壤中重金属能对农作物产生危害的最低限值
D. 土壤中重金属的实际含量
E. 以上都不是

正确答案：B。土壤中重金属不对农作物产生危害的最高限值

解析：本题考查土壤对重金属的环境容量。环境容量是指在一定条件下环境对污染物的最大容纳量。土壤对重金属的环境容量是指土壤中重金属不对农作物产生危害的最高限值（B对ACDE错）。